运动负荷试验阳性的心电图标准是
A. ST段水平型压低≥0.05mV（从J点后0.08秒）
B. ST段上斜型压低≥0.05mV（从J点后0.08秒）
C. ST段弓背向上抬高＞0.1mV（从J点后0.08秒）
D. ST段上斜型压低≥0.1mV（从J点后0.08秒）
E. ST段水平型压低≥0.1mV（从J点后0.08秒）

正确答案：E。ST段水平型压低≥0.1mV（从J点后0.08秒）

解析：ST段上斜型压低是指ST段延长线与R波的垂直线的交角小于80°。一般见于心动过速。近水平型ST段压低是指ST段延长线与R波的垂直线交角≥80°且小于90°。运动负荷试验阳性的心电图标准ST段水平型或下斜型压低≥0.1mV（J点后60～80ms）（E对ABD错）。ST段弓背向上抬高＞0.1mV（从J点后0.08秒）（C错）多为急性心肌梗死的典型表现。